创面常附着泥沙或其他异物属于
A. 挫伤
B. 擦伤
C. 咬伤
D. 刺、割伤
E. 撕裂或撕脱伤

正确答案：B。擦伤

解析：擦伤其特点是皮肤表层破损，创面常附着泥沙或其他异物，有点片状创面或少量点状出血，由于皮肤感觉神经末梢暴露，痛感明显。擦伤的治疗主要是清洗创面，去除附着的异物，防止感染。可用无菌凡士林纱布覆盖，或任其干燥结痂，自行愈合。掌握“口腔颌面部软组织创伤”知识点。